某地某年男性简略寿命表中0岁组的期望寿命是65.5岁。用上述资料编制全人群健康期望寿命表，还需要的最关键数据是
A. 期望寿命
B. 死亡概率
C. 尚存人数
D. 患病率
E. 死亡人数

正确答案：D。患病率

解析：本题考查全人群健康期望寿命表的编制。在编制全人群健康期望寿命表时，需要的最关键数据是患病率（D对ABCE错）。